巨大生长激素瘤首选的治疗方法是
A. 经蝶手术
B. 开颅手术
C. 长效奥曲肽
D. 放疗
E. 溴隐亭

正确答案：A。经蝶手术

解析：无论生长激素微腺瘤或大腺瘤，显微镜下经鼻蝶窦手术治疗通常被作为一线治疗方法（A对），尤其是边界清楚的肿瘤，最好通过手术进行切除。经大脑前叶开颅手术目前已应用较少（B错）。溴隐亭作为多巴胺受体激动剂治疗泌乳素瘤已经有多年安全使用经验，且价格便宜，故临床中亦较常用（E错）。放疗起效慢，并发症多，很少作为垂体肿瘤的首选治疗方式，更多是作为手术及药物治疗的辅助手段，主要指征包括顽固性激素过度分泌、垂体肿瘤切除不全、有手术禁忌或术后肿瘤复发可能性大者（D错）。生长抑素类似物可抑制多种激素分泌，如GH和TSH等，目前已被用于治疗肢端肥大症和TSH分泌型肿瘤，常用生长抑素类似物有奥曲肽（C错）、兰瑞肽等。